计量资料的正确定义是指
A. 每个观察单位的观测值都是绝对数的资料
B. 每个观察单位的观测值都是相对数的资料
C. 每个观察单位的观测值都是平均数的资料
D. 每个观察单位都有1个数值，无论该观测值是绝对数、相对数还是平均数的资料
E. 将每个观察单位按某种属性或类别分组，然后清点各组的观测单位数得到的资料

正确答案：D。每个观察单位都有1个数值，无论该观测值是绝对数、相对数还是平均数的资料

解析：本题考查定量资料的相关内容。计量资料，又称定量资料或数值变量资料，为观测每个观察单位某项指标的大小而获得的资料。其变量值是定量的，表现为数值大小，一般有度量衡单位（D对ABCE错）。